李某，局限性癌切除后，已经处于恢复状态，但仍要求住院观察。该角色行为属于
A. 角色行为异常
B. 角色行为强化
C. 角色行为冲突
D. 角色行为缺如
E. 角色行为减退

正确答案：B。角色行为强化

解析：病人角色适应不良是指病人不能顺利地完成角色转变的过程。常见的角色适应不良有角色行为缺如、角色行为冲突、角色行为减退、角色行为强化、角色行为异常。角色行为减退（E错）是指个体进入病人角色后，由于某种原因又重新承担起本应免除的社会角色的责任，放弃了病人角色去承担其他角色的活动。角色行为缺如（D错）是指病人未能进入病人角色，不承认自己是病人。角色行为冲突（C错）是指当多种社会地位和多种角色集于一人时，在其自身内部产生的冲突。个体在适应病人角色过程中，与其病前的各种角色发生心理冲突而引起行为的不协调。角色行为强化（B对）是指个体“安于”病人角色的现状，角色的行为与其躯体症状不相吻合，过分地对自我能力表示怀疑、失望和忧虑，行为上表现出较强的退缩和依赖性。角色行为异常（A错）是病人无法承受患病或不治之症的挫折和压力，对病人角色感到厌倦、悲观、绝望，由此而导致行为异常。表现出绝望，冷漠，拒绝治疗，直至以自杀手段来解脱病痛之苦，对医护人员产生攻击性行为。